内脏感觉的特点不出现
A. 切割刺激不敏感
B. 痉挛刺激敏感
C. 一般强度的刺激不产生感觉
D. 痛觉定位准确
E. 痛阈较高

正确答案：D。痛觉定位准确

解析：内脏感觉神经的特点为痛阈较高（E对），一般强度的刺激不引起主观感觉（C对），所以对切割刺激不敏感（A对），对痉挛刺激敏感（B对），内脏痛往往是弥散的，定位亦不准确（D错，为本题正确选项）。